女，65岁，刺激性咳嗽1个月，发现痰中带血丝1周，胸部X线片示右肺上叶周围型结节影，大小约2.5cm✕5cm，边界不清，有短毛刺，既往体健，无其他肺部疾病史，吸烟20年，10～20支/日。该患者最可能的诊断是
A. 肺癌
B. 肺真菌感染
C. 肺结核
D. 肺错构瘤
E. 肺脓肿

正确答案：A。肺癌

解析：老年女性患者，20年吸烟史（肺癌高危病因），刺激性咳嗽、痰中带血丝，胸部X线片示右肺上叶周围型结节影，大小约2.5cm✕5cm，边界不清，有短毛刺，最可能的诊断是肺癌（A对）。肺癌多有长期吸烟史，表现为刺激性咳嗽，痰中带血，胸痛和消瘦等症状。胸部X线或CT表现肺癌肿块常呈分叶状，有毛刺、切迹（P69）。肺真菌感染（B错）X线影像表现无特征性，可为支气管肺炎、大叶性肺炎、单发或多发结节，乃至肿块状阴影和空洞（P54）。肺结核（C错）：咳嗽、咳痰两周以上或痰中带血是肺结核的常见可疑症状。肺结核病影像特点是病变多发生在上叶的尖后段、下叶的背段和后基底段，呈多态性，即浸润、增殖、干酪、纤维钙化病变可同时存在，密度不均匀、边缘较清楚和病变变化较慢，易形成空洞和播散病灶（P65）。肺脓肿（E错）多有高热，咳大量脓臭痰。胸片表现为带有液平面的空洞伴周围浓密的炎性阴影（P57）。